男性，70岁，无牙颌5年。初戴全口义齿时，当医生用双手示指分别放在上颌义齿两侧前磨牙区（牙合）面左右交替按压时，见义齿有左右翘动现象。为明确义齿翘动的原因，宜进一步检查
A. 患者的发音
B. 义齿的固位
C. 义齿基托边缘的长度
D. 义齿基托组织面是否有压迫区
E. 义齿的咬合平衡

正确答案：D。义齿基托组织面是否有压迫区

解析：找出义齿左右翘动的原因也就是要确定导致翘动的支点，在支点处基托与黏膜接触紧密，对黏膜压力大，可有黏膜压痛、红肿。掌握“全口义齿戴入后问题及处理”知识点。